下列哪个不是学校健康教育的核心要素
A. 健康知识
B. 健康态度
C. 健康技能
D. 健康行为
E. 健康活动

正确答案：E。健康活动